为增生性的肉芽组织的是
A. 牙髓治疗
B. 牙髓息肉
C. 髓石
D. 弥漫性钙化
E. 成牙本质细胞空泡性变

正确答案：B。牙髓息肉

解析：本题考查牙髓息肉的定义。牙髓息肉（B对）为增生性肉芽组织。牙髓息肉存在于慢性增生性牙髓炎患牙中大而深的龋洞中，呈红色、“蘑菇”形状。牙髓治疗（A错）是关于牙髓的治疗，不是肉芽组织。弥漫性钙化（D错）是牙髓钙化的一种形式，可造成整个髓腔闭锁。髓石（C错）是牙髓钙化的另一种形式，又叫结节性钙化，游离于牙髓组织中或附着在髓腔壁上。成牙本质细胞空泡性变（E错）指成牙本质细胞间液体积聚形成水泡，常因牙髓血供不足、细菌及其毒素刺激、洞形制备的创伤或刺激性充填材料的刺激等所引起。